患者，女，50岁。胃脘胀痛，痛窜两胁，每因情志不舒而加重，嗳气嘈杂，舌淡，脉弦缓。经胃镜检查诊断为慢性浅表性胃炎。治疗应首先考虑的方剂是
A. 四君子汤加减
B. 益胃汤加减
C. 失笑散合丹参饮加减
D. 柴胡舒肝散加减
E. 三仁汤加减

正确答案：D。柴胡舒肝散加减

解析：肝主疏泄而喜条达，若情志不畅，则肝气郁结不得疏泄，横逆犯胃故胃脘胀痛，痛窜两胁，因情志不舒而加重；气机不畅故嗳气嘈杂；舌淡，脉弦缓，均属于肝气郁滞，肝胃不和证。治疗应疏肝行气，活血止痛，首先考虑的方剂是柴胡舒肝散加减（D对）。四君子汤（A错）健脾和胃，温中益气，用于治疗脾胃气虚证。益胃汤（B错）养阴益胃，和中止痛，用于治疗胃阴损伤证。失笑散合丹参饮（C错）化瘀通络，和胃止痛，用于治疗气血瘀滞之心胃诸痛。三仁汤（E错）清利湿热，醒脾化浊，用于治疗湿温初起，湿重于热者。